新生儿尤其是早产儿易发生寒冷损伤综合征的病理生理中，错误的是
A. 体温调节中枢不成熟
B. 皮肤表面积相对较大
C. 血流较丰富
D. 棕色脂肪含量较多
E. 体内能量储存少

正确答案：D。棕色脂肪含量较多

解析：新生儿寒冷损伤综合征的病因有3种，以寒冷和保温不足最多见。新生儿尤其是早产儿，体温调节中枢不成熟（A对）、皮肤表面积相对较大（B对）、血流较丰富（C对）、体内能量存储少（E对）都可引起保温不足。新生儿由于缺乏寒战反应，寒冷时主要靠棕色脂肪代偿产热，因此棕色脂肪含量较多时代偿产热能力较强，不易发生新生儿寒冷损伤综合征（D错，为本题正确答案）。